躯体疾病所致精神障碍的处理原则不正确的是
A. 对精神症状的控制应遵从大剂量，足疗程的原则
B. 维持水电解质平衡，充足的营养供应等支持治疗
C. 要考虑治疗药物对病人的副作用
D. 安静，安全的环境和防止意外发生等护理措施
E. 首先必须治疗引起精神障碍的原发躯体疾病

正确答案：A。对精神症状的控制应遵从大剂量，足疗程的原则

解析：躯体疾病所致精神障碍是由脑以外的躯体疾病，如躯体感染、内脏器官疾病、内分泌障碍、营养代谢疾病等，引起脑功能紊乱而产生的精神障碍。躯体疾病的支持治疗是维持水电解质平衡，充足的营养供应等支持治疗（B对），加强脑保护治疗，采取安静，安全的环境和防止意外发生等护理措施（D对）。躯体疾病还需要控制患者精神症状，因年龄、躯体疾病、药物间的相互作用等原因，对于躯体疾病所致精神障碍的患者，使用精神药物要慎重，起始剂量应更低，剂量应逐渐增加，当症状稳定时，应考虑逐渐减少剂量，同时要考虑治疗药物对病人的副作用（C对），不应遵从大剂量，足疗程的原则（A错，为本题正确答案）。躯体疾病的病因治疗是首先必须治疗引起精神障碍的原发躯体疾病（E对），停用可能引起精神障碍的药物等。